前列腺增生早期最常见的症状
A. 尿频
B. 尿急
C. 尿痛
D. 血尿
E. 蛋白尿

正确答案：A。尿频